规范文化不包括
A. 宗教信仰
B. 法律
C. 伦理道德
D. 教育
E. 风俗习惯

正确答案：A。宗教信仰

解析：本题考查规范文化。规范文化包括社会制度、教育（D对）、法律（B对）、风俗习惯（E对）、伦理道德（C对）等。宗教信仰（A错，为本题正确答案）属于思想文化。